A县张某系霍乱患者，在B市传染病医院隔离治疗期间，擅自逃出医院回到A县，脱离隔离治疗。为防止霍乱传播，可以协助传染病医院追回张某采取强制隔离治疗措施的机构是
A. 卫生行政部门
B. 疾病控制中心
C. 民政部门
D. 司法机关
E. 公安机关

正确答案：E。公安机关